食物蛋白质的营养互补作用是
A. 蛋白质的营养价值与脂肪酸的作用互补
B. 营养必需氨基酸与营养必需微量元素的互补
C. 营养必需氨基酸之间的互相补充
D. 营养必需氨基酸和非营养必需氨基酸互补
E. 营养物质与非营养物质的互补

正确答案：C。营养必需氨基酸之间的互相补充

解析：食物蛋白质的营养互补作用是指营养价值较低的蛋白质混合食用，彼此间营养必需氨基酸之间的互相补充（C对），从而提高蛋白质的营养价值。